属于小RNA病毒科嗜肝病毒属的是
A. HAV
B. HBV
C. HCV
D. HDV
E. HEV

正确答案：A。HAV

解析：甲型肝炎病毒（HAV）属于小RNA病毒科嗜肝病毒属，病毒直径约为27nm，呈20面体立体对称，无包膜。掌握“甲型肝炎病毒”知识点。